治疗痰壅气逆，咳喘痰多，胸闷食少，甚则不能平卧，宜选用的药组是
A. 紫苏子、白芥子、莱菔子
B. 紫菀、款冬花、川贝母
C. 桑叶、贝母、北沙参
D. 杏仁、麻黄、甘草
E. 麻黄、石膏、杏仁

正确答案：A。紫苏子、白芥子、莱菔子

解析：紫苏子主入肺经，善于降肺气，化痰涎而止咳平喘；白芥子辛温力雄，性善走散，能散肺寒，利气机，豁寒痰，逐水饮；莱菔子既能消食化积，又能降气化痰。紫苏子、白芥子、莱菔子同用，治疗痰壅气逆，咳喘痰多，胸闷食少，甚则不能平卧（A对）。